下列属于临床常见的I型超敏反应性疾病的是
A. 皮肤过敏反应
B. 消化道过敏反应
C. 呼吸道过敏反应
D. 药物过敏性休克
E. 以上说法均正确

正确答案：E。以上说法均正确

解析：临床常见的I型超敏反应性疾病：1)药物过敏性休克。2)呼吸道过敏反应。3)消化道过敏反应。4)皮肤过敏反应。掌握“概述及Ⅰ型超敏反应”知识点。